肾蒂内主要结构由前向后排列依次为
A. 肾动脉、肾静脉、肾盂
B. 肾盂、肾动脉、肾静脉
C. 肾静脉、肾盂、肾动脉
D. 肾静脉、肾动脉、肾盂
E. 肾动脉、肾盂、肾静脉

正确答案：D。肾静脉、肾动脉、肾盂

解析：肾蒂内主要结构由前向后排列依次为肾静脉、肾动脉、肾盂末端（D对）。